含有吲哚羧酸酯结构的5-HT₃受体拮抗剂是
A. 盐酸昂丹司琼
B. 格拉司琼
C. 盐酸托烷司琼
D. 盐酸帕洛诺司琼
E. 盐酸阿扎司琼

正确答案：C。盐酸托烷司琼

解析：本题考查5-HT₃受体拮抗剂。盐酸托烷司琼（C对）分子是由吲哚环和托品醇组成，对外周神经元和中枢神经内5-HT₃受体具高选择性阻断作用。盐酸昂丹司琼（A错）分子由咔唑酮和2-甲基咪唑组成。格拉司琼（B错）分子是由吲唑环和含氮双环组成。盐酸帕诺司琼（D错）是分子由苯并异喹啉和手性氮杂双环组成。盐酸阿扎司琼（E错）是由1，4-苯并噁嗪和氮杂双环组成。